下列哪项不是学校开展生活技能教育的现实意义
A. 提高学生心理社会能力
B. 增强青少年自我意识
C. 预防健康危险行为
D. 促进青少年终生健康的有效途径
E. 提高儿童青少年的健康知识

正确答案：E。提高儿童青少年的健康知识